苯二氮（艹卓）类药物的作用机制是
A. 直接和GABA受体结合，增加GABA神经元的功能
B. 与苯二氮（艹卓）类受体结合，生成新的抑制性蛋白起作用
C. 不通过受体，直接抑制中枢神经系统的功能
D. 与其受体结合后促进GABA与相应受体结合，增加Cl-通道开放频率
E. 与其受体结合后促进GABA与相应受体结合，增加Cl-通道开放的时间

正确答案：D。与其受体结合后促进GABA与相应受体结合，增加Cl-通道开放频率

解析：目前认为，苯二氮（艹卓）类的中枢作用主要与药物加强中枢抑制性神经递质γ-氨基丁酸（GABA）功能有关，还可能和药物作用于不同部位的GABAA受体密切相关。GABA作用于GABAA受体，使细胞膜对Cl-通透性增加，Cl-大量进入细胞膜内引起膜超极化，使神经元兴奋性降低。苯二氮（艹卓）类与GABAA受体复合物上的BZ受点结合，可以诱导受体发生构象变化，促进GABA与GABAA受体结合，增加Cl-通道开放的频率而增加Cl-内流，产生中枢抑制效应。掌握“苯二氮?类”知识点。